可竞争血浆蛋白结合部位，增加甲氨蝶呤肝脏毒性的药物是
A. 去甲肾上腺素
B. 华法林
C. 阿司匹林
D. 异丙肾上腺素
E. 甲苯磺丁脲

正确答案：C。阿司匹林

解析：本题考查药物的相互作用。可竞争血浆蛋白结合部位，增加甲氨蝶呤肝脏毒性的药物是阿司匹林（C对）。阿司匹林、吲哚美辛、氯贝丁酯、保泰松、水合氯醛及磺胺药等都有蛋白置换作用，如阿司匹林增加甲氨蝶呤的肝脏毒性。去甲肾上腺素（A错）可减少利多卡因肝脏中分布量，减少其代谢，增加其血中浓度。华法林（B错）主要经肝脏CYP450酶代谢，能够抑制CYP活性的药物，如甲硝唑、氯霉素、西咪替丁、奥美拉唑和选择性5-羟色胺再摄取抑制药等，均可使华法林的代谢减慢，半衰期延长，抗凝作用加强。异丙肾上腺素（D错）与全麻药合用，可增加发生室性心律失常的可能性。甲苯磺丁脲（E错）与普萘洛尔、氢氯噻嗪、氯丙嗪、乙醇、赛庚啶和雄性激素等合用将减弱其降血糖作用。